对于二项分布资料，Sp表示
A. 总体率的标准差
B. 样本率的方差
C. 样本率的标准差
D. 样本的标准差
E. 样本的方差

正确答案：C。样本率的标准差